接触职业性有害因素的劳动者是否发生职业性疾患主要取决于
A. 有害因素种类
B. 接触方式
C. 接触机会
D. 接触的浓度（强度）和时间
E. 人体的健康状况

正确答案：D。接触的浓度（强度）和时间

解析：接触职业性有害因素的劳动者是否发生职业性疾患主要取决于接触的浓度（强度）和时间（D对）。